影响根分叉病变治疗效果的局部原因主要是
A. 解剖特点
B. 细菌毒力较强
C. 细菌数量多
D. 咬合面形态
E. 牙根数目较多

正确答案：A。解剖特点

解析：本题考查影响根分叉病变治疗效果的原因。影响根分叉病变治疗效果的局部原因主要是解剖特点（A对）：包括分叉的形态，两根（或三根）之间的分叉角度过小会妨碍刮治器的进入；根面的凹陷，使得细菌容易进入牙根面，造成牙槽骨的吸收和附着丧失，使得根分叉暴露；骨破坏形态的复杂性，导致预后和预想之间存在差距，影响预后等。细菌毒力（B错）和数量（C错）也会影响根分叉病变治疗效果，但不是主要因素，当根分叉解剖特点良好时，可以有助于去除细菌。咬合面形态（D错）不会影响根分叉病变治疗效果。牙根数目过多（E错）亦不是影响根分叉病变治疗效果的原因。